从预防有机磷农药中毒角度，判断下列哪一种做法是错误的
A. 施药时使用浸酸液纱布口罩，防止吸入中毒
B. 施药时穿长袖衣、长裤、使用塑料围裙、鞋套、鞋盖等及防护口罩
C. 配药和检修施药工具时戴胶皮手套
D. 污染的工作服用碱液浸泡后用清水洗净
E. 施药前用肥皂涂抹皮肤，减少药剂经皮吸收

正确答案：A。施药时使用浸酸液纱布口罩，防止吸入中毒